新生儿寒冷损伤综合征患儿复温后，维持正常体温的治疗关键是
A. 补充热卡
B. 抗感染治疗
C. 改善微循环
D. 正压通气给氧
E. 纠正代谢紊乱

正确答案：A。补充热卡

解析：新生儿寒冷损伤综合征患儿复温后，维持正常体温的治疗关键是补充热卡，热量供给从每日210kJ/kg（50kcal/kg）开始，逐渐增加至每日419～502kJ/kg（100～120kcal/kg）（A对）。若有感染才用抗感染治疗（B错）。改善微循环（C错）、正压通气给氧（D错）、纠正代谢紊乱（E错）是针对严重新生儿寒冷损伤综合征的并发症治疗，并不是关键治疗。